由于医务人员医疗技术水平低所构成对患者安全威胁的因素属于
A. 医院服务因素
B. 医院专业因素
C. 医院管理因素
D. 医院社会因素
E. 医院环境因素

正确答案：B。医院专业因素

解析：心医院常见的有害因素包括医院专业因素、医院管理因素、医院社会因素、医院环境因素四项，故可首先排除医院服务因素（A错）。医院专业因素（B对）也称医源性因素，主要是指医务人员在专业操作过程中的不当或过失行为，给患者造成的不安全感或者不安全结果。医院专业因素是临床上造成患者医疗不安全的主要因素。医院管理因素（C错）是指由于医院的各项组织管理措施不到位或不落实、运行机制不顺畅等原因造成的患者或医务人员安全受到威胁的因素。医院社会因素（D错）是指可能引发患者和医务人员健康危害的医院相关的外界社会因素。医院环境因素（E错）是医院建筑卫生、卫生工程、消毒隔离、环境卫生、营养卫生、作业劳动卫生等诸环境卫生学因素对患者和医务人员健康和安全的潜在威胁。